男，27岁。发热头晕视物模糊1周。血常规示Hb69g/L，WBC15×10⁹/L，分类中可见原始细胞。本患者骨髓涂片中早幼粒细胞占0.60。首选治疗为
A. 长春新碱+泼尼松
B. 环磷酰胺+泼尼松
C. 柔红霉素+阿糖胞苷
D. 三尖杉酯碱+阿糖胞苷
E. 全反式维甲酸

正确答案：E。全反式维甲酸

解析：患者骨髓涂片中早幼粒细胞占0.60，诊断为M₃型（急性早幼粒细胞白血病APL），治疗首选全反式维A酸（ATRA）（E对）。长春新碱+泼尼松（VP方案）（P575）（A错）是急性淋巴细胞白血病的基本化疗方案；柔红霉素+阿糖胞苷（DA方案）（P576）（C错）、三尖杉酯碱+阿糖胞苷（HA方案）（P576）（D错）是急性髓系白血病AML（非APL）的常用化疗方案；环磷酰胺+泼尼松（P581-P582）（B错）可用于慢性淋巴细胞白血病的治疗。